反映糖尿病长期血糖控制程度的指标是
A. 空腹静脉血糖
B. 空腹指尖血糖
C. 糖化血红蛋白
D. 葡萄糖耐量试验
E. 胰岛素释放试验

正确答案：C。糖化血红蛋白